男，68岁，2周来反复胸痛，发作与劳累及情绪有关，休息可以缓解。3小时前出现持续性疼痛，进行性加剧，并气促，不能平卧，血压110/70mmHg，心率120次/分，律齐，心尖部可闻及3/6级收缩期杂音，双肺散在哮鸣音及湿性啰音。首选检查为
A. X线胸片
B. 心电图
C. 超声心动图
D. 血清心肌酶
E. 心肌核素扫描

正确答案：B。心电图

解析：患者老年男性，反复发作胸痛，且与劳累及情绪有关，休息可以缓解，提示为心绞痛（急性心肌梗死常见前驱症状）。3小时前出现持续性疼痛，进行性加剧，心尖部可闻及Ⅲ级收缩期杂音（可由心肌缺血导致的乳头肌功能失调或断裂引起二尖瓣脱垂后产生），提示患者已发展为急性心肌梗死。患者气促，不能平卧，双肺散在哮鸣音及湿性啰音，考虑为急性左心衰竭。综上所诉，该病人的诊断最可能是急性心肌梗死并发左心衰竭。心电图（B对）对急性心肌梗死的诊断、定位、定范围、估计病情演变和预后都有帮助，且价格便宜，操作方便，因此应作为该患者首选检查。X线胸片（A错）对急性心肌梗死并无特异的诊断意义，仅有助于了解其他心肺疾病的情况，如有无心脏增大、充血性心力衰竭等。超声心动图（P238）（C错）多用于了解心室壁的运动和左心室功能，诊断室壁瘤和乳头肌功能失调，检测心包积液及室间隔穿孔等并发症，对急性心肌梗死的诊断意义不大。血清心肌酶（P239）（D错）包括肌酸激酶、天冬氨酸氨基转移酶以及乳酸脱氢酶，其特异性及敏感性均远不如上述心肌坏死标记物，已不再用于诊断急性心肌梗死。心肌核素扫描（E错）主要用于观察心肌梗死后心肌的存活性，目前临床已很少应用。